夏季，3岁小儿突然高热，体温40℃，惊厥1次。体检：神清，面色红。咽红，心、肺、腹（-），神经系统未见异常。最可能的诊断是
A. 高热惊厥
B. 中毒性痢疾
C. 流行性脑膜炎
D. 结核性脑膜炎
E. 脑脓肿

正确答案：A。高热惊厥

解析：学龄前儿童，夏季突发高热，体温40℃，惊厥1次，查体：神清，面色红，咽红，心、肺、腹（-），神经系统未见异常，根据患儿的临床症状及体征，考虑最可能的诊断为高热惊厥（A对），中毒性痢疾（B错）除有全身中毒症状外还伴有腹泻，黏液脓血便，脑膜炎（CD错）及脑脓肿（E错）患者神经检查系统存在异常。